可承载生物遗传信息的分子结构是
A. 多不饱和脂肪酸的双键位置
B. 氨基酸的侧链基团
C. 脂蛋白的脂质组成
D. 核酸的核苷酸序列
E. 胆固醇的侧链碳原子

正确答案：D。核酸的核苷酸序列